蝉蜕的主要归经是
A. 肺、脾
B. 肺、肾
C. 肺、心
D. 肺、肝
E. 肺、大肠

正确答案：D。肺、肝

解析：本题考查蝉蜕归经，属记忆内容。蝉蜕药性甘、寒。归肺、肝经（D对）。